关于下列口腔毛状白斑镜下表现描述不正确的一项是
A. 上皮钉突肥厚并伸长
B. 棘层明显增生
C. 靠近表层1/3的棘细胞层可见气球样细胞
D. 电镜观察细胞质内，有大量病毒颗粒
E. 上皮下结缔组织内的炎症明显

正确答案：E。上皮下结缔组织内的炎症明显

解析：本题考查口腔毛状白班的病理变化。上皮下结缔组织内的炎症明显（E错，为本题正确答案）不符合口腔毛状白斑镜下表现。上皮的表层常可见念珠菌侵入，但是固有层很少有炎症表现。口腔毛状白班常有以下病理变化：表现为显著的上皮增生和过度角化，上皮钉突肥厚并伸长（A对），下方的棘层细胞空泡变性或气球样变，棘层明显增生（B对），角化层下方出现气球样细胞带（C对），电镜观察细胞质内，有大量病毒颗粒（D对），由于病毒DNA大量复制，细胞核变透明。上皮表层常见念珠菌侵入，但固有层很少有炎症表现。